错误的是
A. 位于额下回后部
B. 又称Broca语言区
C. 管理与语言相关的喉、舌、唇、下颌等肌肉的联合运动
D. 损伤后出现运动性失语症
E. 位置均在左半球上

正确答案：E。位置均在左半球上

解析：运动性语言中枢位于额下回后部（A对），又称Broca语言区（B对）。该中枢主司说话功能，管理与语言相关的喉、舌、唇、下颌等肌肉的联合运动（C对），损伤后可出现运动性失语症（D对），表现为病人虽能发音，却不能说出具有意义的语言。大部分情况下，左侧大脑半球与语言、意识、数学分析等密切相关，因此语言中枢主要在左侧大脑半球，但E选项（E错，为本题正确答案）叙述过于绝对，有欠妥当。